发生传染病流行时，县级以上地方政府有权在本行政区域内
A. 调集各级各类医疗防疫人员参加疫情控制工作
B. 停工停业停课
C. 封锁甲类或按甲类传染病管理的传染病疫区
D. 封锁跨省自治区直辖市的疫区
E. 宣布疫区

正确答案：A。调集各级各类医疗防疫人员参加疫情控制工作

解析：传染病暴发、流行时，根据传染病疫情控制的需要，县级以上地方人民政府有权在本行政区域内紧急调集各级各类医疗防疫人员参加疫情控制工作（A对）。停工、停业、停课（B错）须报经上一级人民政府决定。省、自治区、直辖市人民政府可以在本行政区域内封锁甲类或按甲类传染病管理的传染病疫区（C错）。封锁跨省自治区直辖市的疫区（D错），由国务院决定。甲类、乙类传染病暴发、流行时，县级以上地方人民政府报经上一级人民政府决定，可以将本行政区域部分或者全部宣布为疫区（E错）。